全口义齿的（牙合）平面平分颌间距的主要目的是
A. 加强义齿的稳定和固位
B. 提高咀嚼效率
C. 增强义齿强度
D. 容易取得平衡（牙合）
E. 方便排牙

正确答案：A。加强义齿的稳定和固位

解析：本题考查全口义齿的（牙合）平面平分颌间距的目的。全口义齿的（牙合）平面平分颌间距，才能使义齿在各个方向受到的力相对平衡，避免以牙槽嵴顶为支点产生翘动，加强义齿的稳定和固位（A对）。提高咀嚼效率（B错）通过使用解剖式牙，达到最广泛的尖窝接触关系来实现；增强义齿强度（C错）通过增加义齿厚度，选用强度高的基托、人工牙材料和使用金属固位网来实现；前牙排成浅覆（牙合）、浅覆盖（D错）容易获得平衡（牙合），这些都与平分颌间距离无关。方便排牙（E错）与全口义齿的（牙合）平面平分颌间距有关，但不是其最主要的目的。